合理用药的生物医学标准不包括
A. 药物正确无误
B. 尽量选用国产药
C. 用药指征适宜
D. 用药对象适宜
E. 剂量、用法、疗程得当

正确答案：B。尽量选用国产药